抗结核病药的应用原则包括
A. 早期用药
B. 预防用药
C. 联合用药
D. 短期、全疗程、规范用药
E. 长期、全疗程、规范用药

正确答案：A、C、E。早期用药；联合用药；长期、全疗程、规范用药

解析：本题考查抗结核病的使用原则。对结核病的化学药物治疗，应遵循“早期用药（A对）、规律用药、全程用药、适量用药、联合用药（C对）”的五项原则。结核病的治疗方案有初治、复治等，但不需预防性治疗（B错）。结核分枝杆菌感染对药物的治疗反应缓慢，故需要长期全程治疗（E对D错）。